过去美国洛杉矶、纽约和日本东京、大阪曾多次发生急性中毒烟雾事件，其污染物是
A. 煤烟烟雾
B. 酸雾
C. 光化学烟雾
D. 异氰酸甲酯毒雾
E. SO2与金属粉尘混合性烟雾

正确答案：C。光化学烟雾

解析：本题考查光化学烟雾事件。过去美国洛杉矶、纽约和日本东京、大阪曾多次发生急性中毒烟雾事件，其污染物是光化学型烟雾（C对ABDE错）。光化学烟雾是由汽车尾气、工业废气和其他污染源排放的气态污染物，如氮氧化物、硫氧化物、一氧化碳和有机物等，在空气中受到太阳光的照射而产生的混合物。